舌绛少苔而润，属于
A. 阴虚火旺
B. 营血有热
C. 表热证
D. 血瘀证
E. 气分热盛

正确答案：D。血瘀证

解析：舌绛少苔而津润者，多为血瘀（D对）。阴虚火旺则舌色鲜红而少苔，或有裂纹（A错）。热入营血则舌红降（B错）。表热证见舌淡红，苔薄黄（C错）。气分热盛则舌红苔黄（E错）。